根尖肉芽肿的上皮主要来源于
A. 缩余釉上皮
B. Malassez上皮剩余
C. 牙龈上皮
D. 牙板上皮
E. 腺上皮

正确答案：B。Malassez上皮剩余

解析：本题考查根尖肉芽肿的上皮来源。根尖肉芽肿的上皮主要来源于Malassez上皮剩余（B对）。1.根尖肉芽肿的上皮来源：①Malassez上皮剩余；②经瘘道口长入的口腔黏膜上皮或皮肤的表皮；③牙周袋壁上皮；④呼吸道上皮。2.牙源性囊肿的衬里上皮来源于牙源性上皮剩余，但不同囊肿可能来源于不同的上皮剩余：①牙板上皮（D错）剩余或Serres上皮剩余可发生发育性根侧囊肿和牙龈囊肿；②缩余釉上皮（A错）发生的囊肿有含牙囊肿、萌出囊肿以及炎性牙旁囊肿；③Malassez上皮剩余发生根尖周囊肿、残余囊肿和炎性根侧囊肿。